新生儿溶血症的换血量约为婴儿全血量的
A. 1倍
B. 1.5倍
C. 2倍
D. 2.5倍
E. 3倍

正确答案：C。2倍

解析：新生儿溶血症行换血治疗，可置换出部分血中游离抗体和致敏红细胞，减轻溶血；换出血中大量胆红素，防止发生胆红素脑病；纠正贫血，改善携氧，防止心力衰竭。换血量一般为患儿血量的2倍（C对），大约可置换出85%的致敏红细胞和60%的胆红素及抗体。也有人主张用3倍血（E错），以换出更多的致敏红细胞、胆红素及抗体，但所需的时间较长并对患儿循环影响较大。